属髂外动脉分支的是
A. 旋股外侧动脉
B. 旋髂浅动脉
C. 闭孔动脉
D. 腹壁下动脉
E. 旋股内侧动脉

正确答案：D。腹壁下动脉

解析：腹壁下动脉（D对）属髂外动脉分支，为髂外动脉在腹股沟韧带的稍上方发出腹壁下动脉。